Liebermann-Burchard反应呈阳性的苷类有
A. 五环三萜皂苷
B. 黄酮苷
C. 甾体皂苷
D. 环烯醚萜苷
E. 四环三萜皂苷

正确答案：A、C、E。五环三萜皂苷；甾体皂苷；四环三萜皂苷

解析：本题考查三萜皂苷与甾体皂苷的显色反应。Liebermann-Burchard反应呈阳性的苷类有五环三萜皂苷（A对）、甾体皂苷（C对）、四环三萜皂苷（E对）。醋酐-浓硫酸（Liebermann-BurChard）反应：将样品溶于醋酐中，加入浓硫酸-醋酐（1：20）数滴，显色，颜色变化与Liebermann反应相同。此反应可以区分三萜皂苷和甾体皂苷，前者最后呈红色或紫色，后者最终呈蓝绿色。盐酸-镁粉（或锌粉）反应是鉴别黄酮类（B错）化合物最常用的颜色反应。环烯醚萜类（D错）：环烯醚萜类为臭蚁二醛的缩醛衍生物，属单萜类化合物。